有关颗粒剂的叙述，正确的有
A. 按溶解性能和溶解状态，颗粒剂可分为可溶性颗粒剂、混悬性颗粒剂和泡腾性颗粒剂
B. 挤出制粒、快速搅拌制粒、流化喷雾制粒和干法制粒等是颗粒剂制备常用的制粒方法
C. 颗粒剂制备时，辅料的总用量一般不宜超过稠膏量的5倍
D. 酒溶性颗粒剂制备时，原料药的提取应以一定浓度的乙醇为溶剂
E. 混悬性颗粒剂制备时，通常将含热敏性、挥发性成分或淀粉较多的药材以及贵重细料药等粉碎成细粉备用

正确答案：A、B、C、D、E。按溶解性能和溶解状态，颗粒剂可分为可溶性颗粒剂、混悬性颗粒剂和泡腾性颗粒剂；挤出制粒、快速搅拌制粒、流化喷雾制粒和干法制粒等是颗粒剂制备常用的制粒方法；颗粒剂制备时，辅料的总用量一般不宜超过稠膏量的5倍；酒溶性颗粒剂制备时，原料药的提取应以一定浓度的乙醇为溶剂；混悬性颗粒剂制备时，通常将含热敏性、挥发性成分或淀粉较多的药材以及贵重细料药等粉碎成细粉备用